下列哪项不是代谢性酸中毒的病因？
A. 休克
B. 幽门梗阻
C. 肾功能衰竭
D. 心力衰竭
E. 糖尿病

正确答案：B。幽门梗阻

解析：幽门梗阻（B错，为本题正确答案）后由于胃无法排空而呕吐，会使富含HCl的胃液大量丢失而导致代谢性碱中毒。休克（A对）、心力衰竭（D对）引起的缺氧使细胞内糖的无氧酵解增强而引起乳酸增加，产生乳酸性酸中毒。肾功能衰竭（C对）患者，体内固定酸不能由尿中排泄，导致酸在体内积蓄而发生代谢性酸中毒。糖尿病（E对）患者由于胰岛素不足，使葡萄糖利用减少，脂肪分解加速，大量脂肪酸进入肝，形成过多的酮体，超过了外周组织的氧化能力及肾排出 能力时可发生酮症酸中毒。